洋地黄中毒所致的室性心动过速忌用
A. 利多卡因
B. 普罗帕酮
C. 苯妥英钠
D. 氯化钾
E. 直流电复律

正确答案：E。直流电复律

解析：洋地黄可抑制Na⁺-K⁺-ATP酶，导致细胞内低K⁺，使相对不应期延长，此时若提前激动心肌可能会引发室颤；并且洋地黄抑制房室结，如果在洋地黄中毒时使用直流电复律（E错，为本题正确答案），由于房室传导阻滞，窦房结冲动无法下传，心室肌自律性增加，在相对不应期延长的背景下也容易引发室颤。普罗帕酮（B对）为广谱抗心律失常药物，可用于各种类型室上性心动过速；室性期前收缩，难治性、致命性室速。利多卡因（A对）为ⅠB类抗心律失常药，可用于治疗洋地黄中毒所引起的室性心动过速和心室颤动，苯妥英钠（C对）为ⅠB类抗心律失常药，不仅有抗心律失常作用，还能与洋地黄竞争Na⁺-K⁺-ATP酶，恢复该酶的活性，因而有解毒效应。氯化钾（D对）是治疗洋地黄中毒所致的室性心动过速的有效药物，因钾离子能与洋地黄竞争心肌细胞膜上的Na⁺-K⁺-ATP酶，减少洋地黄与酶的结合，从而减轻或阻止毒性的发生和发展。本题具体可参考九版药理学P237。